观察课堂上学生做小动作、瞌睡等行为属于学习疲劳评价方法中的
A. 体征与行为观察法
B. 教育心理学方法
C. 生理学方法
D. 生理-教育心理结合法
E. 社会心理学方法

正确答案：A。体征与行为观察法